常用于急救、补充体液和营养，一次给药体积可多至数千毫升的是
A. 静脉滴注
B. 皮下注射
C. 肌内注射
D. 皮内注射
E. 脊椎腔注射

正确答案：A。静脉滴注